一下颌双尖牙，活髓，全冠修复水门汀粘固后第2天出现自发痛，最可能的原因是
A. 牙髓炎
B. （牙合）创伤
C. 根尖周炎
D. 牙髓充血
E. 以上都不是

正确答案：A。牙髓炎

解析：本题考查修复后可能出现的问题-疼痛。病例中的患牙为活髓，水门汀粘固后出现自发痛，最可能是由于牙体组织磨除过多，粘固前未戴暂时冠，未做牙髓安抚治疗，牙髓受刺激，逐渐由牙髓充血发展为牙髓炎（A对）。（牙合）创伤只是一个重要的局部促进因素，单纯早期的（牙合）创伤（B错）只引起牙槽骨、牙周膜和牙骨质的变化，并不影响牙髓组织。根尖周炎（C错）一般无明显的自觉症状，有的患牙可在咀嚼时有不适感，且一般都是牙髓炎继发引起。病理性的牙髓充血（D错）实际上是牙髓的早期改变，大多由深龋引起，主要表现为牙本质过敏，患牙遇冷刺激可出现一过性的疼痛反应，刺激去除后疼痛随即消失，一般无自发痛。